在进行某病的队列研究时，最初选择的队列组成是
A. 患该病的患者
B. 未患该病的人
C. 具有所要调查该项因素的人
D. 具有该病家族史的人
E. 没有所要调查该项因素的人

正确答案：B。未患该病的人